梅毒的病原体属于
A. 细菌
B. 衣原体
C. 病毒
D. 螺旋体
E. 真菌

正确答案：D。螺旋体

解析：本题考查梅毒的病原体。梅毒的病原体为螺旋体（D对ABCE错），性传播的梅毒螺旋体在体内潜伏多年后可进入脑内，导致神经梅毒，主要表现为神经系统的退行性变。